碘解磷定
A. 可以多种途径给药
B. 不良反应比氯磷定少
C. 可以与胆碱受体结合
D. 可以直接对抗体内聚集的乙酰胆碱的作用
E. 与磷酰化胆碱酯酶结合后，才能使酶活性恢复

正确答案：E。与磷酰化胆碱酯酶结合后，才能使酶活性恢复